具有“升举内脏”功能，维持内脏位置相对恒定的脏是
A. 肝
B. 心
C. 脾
D. 肺
E. 肾

正确答案：C。脾

解析：脾气宜升，指脾气以上升为主，以升为健的气机运动特点。主要体现在脾主升清和升举内脏，其中升举内脏是指脾气上升能维持内脏位置的相对恒定，是防止内脏下垂的重要保证（C对）。若脾气虚弱，无力升举，反而下陷，可导致某些内脏下垂，如胃下垂、肾下垂、阴挺（子宫脱垂）、脱肛（直肠脱垂）等。临床治疗常采用健脾升陷的补中益气汤。肝的生理特性有肝主升发、肝喜条达而恶抑郁（A错）；心的生理特性有心主通明、心火宜降（B错）；肺的生理特性有肺为华盖、肺为娇脏、肺气宣降、肺喜润恶燥（D错）；肾的生理特性有肾主蛰藏、肾水宜升、肾恶燥（E错）。